有关巩膜静脉窦正确的是
A. 位于角膜与虹膜交界处
B. 和眼后房直接相连
C. 位于虹膜与睫状体交界处
D. 是产生房水的部位
E. 位于角膜与巩膜交界处

正确答案：E。位于角膜与巩膜交界处

解析：巩膜静脉窦位于角膜与巩膜交界处（E对），而非角膜与虹膜交界处（A错）或虹膜与睫状体交界处（C错），与眼前房直接相连，而非眼后房（B错），是房水流出的通道，而非产生房水的部位（D错）。产生房水的部位是睫状体。